五磨饮子适用于喘证之
A. 上实下虚证
B. 痰浊阻肺证
C. 肺气郁痹证
D. 表寒里热证
E. 痰热郁肺证

正确答案：C。肺气郁痹证

解析：喘证之上实下虚证应选用苏子降气汤（A错）。喘证之痰浊阻肺证应选用二陈汤合三子养亲汤（B错）。情志不遂，气机不利，肺气不得肃降，气逆而喘，即喘证之肺气郁痹证，应用五磨饮子开郁降气平喘（C对）。喘证之表寒里热证应用麻杏甘石汤（D错）。喘证之痰热郁肺证应用桑白皮汤（E错）。